以下关于“儿童心理健康标准”哪一条是错误的
A. 智力发育正常
B. 情绪稳定协调
C. 行为特征符合实际年龄
D. 能客观地看待环境和自己
E. 良好的人际关系

正确答案：D。能客观地看待环境和自己

解析：本题考查儿童心理健康的标准。儿童心理健康的标准为：1.智力发育正常（A对）；2.情绪稳定协调（B对）；3.行为特征与实际年龄相符合（C对）；4.行为协调，反应适度；5.良好的人际关系（E对）。能客观地看待环境和自己（D错，为本题正确答案）不属于儿童心理健康的标准。